应激源按属性分为四种，不包括
A. 躯体性应激源
B. 心理性应激源
C. 社会性应激源
D. 文化性应激源
E. 外界环境应激源

正确答案：E。外界环境应激源